最易与输卵管妊娠破裂相混淆的疾病是
A. 急性阑尾炎
B. 输卵管卵巢囊肿
C. 稽留流产
D. 卵巢黄体破裂
E. 子宫穿孔

正确答案：D。卵巢黄体破裂

解析：输卵管妊娠破裂表现为突发一侧下腹部撕裂样剧痛，阴道流血较少，可短期内多量腹腔内出血导致失血性休克；卵巢黄体破裂（P55）表现为下腹一侧突发性疼痛，阴道无流血或有如月经量流血，可表现为轻度休克。两者均有一侧附件区压痛，B超检查均有一侧附件区低回声，故最易混淆（D对）。急性阑尾炎（P55）（A错）表现为转移性右下腹疼痛，无阴道流血，B超检查子宫附件区无异常回声；输卵管卵巢囊肿（P324）（B错）为炎性积液，常有盆腔炎性疾病史，两侧附件区有不规则条形囊性包块，边界较清，活动受限；稽留流产（P49）（C错）表现为停经后阴道流血和腹痛，早孕反应消失，有先兆流产症状或无任何症状，子宫较停经周数小；子宫穿孔（P384）（E错）常发生于人流或刮宫术中，术者突然感到无宫底感觉，病人突然感到下腹疼痛，均无腹腔内出血的表现。